适用于同侧上颌切牙至前磨牙的拔除，牙槽突修整及上颌囊肿刮治术和唇裂修复等手术
A. 上牙槽后神经阻滞麻醉
B. 眶下神经阻滞麻醉
C. 腭前神经阻滞麻醉
D. 鼻腭神经阻滞麻醉
E. 下牙槽神经阻滞麻醉

正确答案：B。眶下神经阻滞麻醉

解析：眶下神经阻滞麻醉：又称眶下孔或眶下管注射法，将麻药注入眶下孔或眶下管，以麻醉眶下神经及其分支，可麻醉上牙槽前、中神经，甚至上牙槽后神经，即可麻醉整个上颌牙神经丛。本方法适用于同侧上颌切牙至前磨牙的拔除，牙槽突修整及上颌囊肿刮治术和唇裂修复等手术。掌握“颌面部常用局麻法及牙拔除的麻醉选择”知识点。